不支持新生儿化脓性脑膜炎临床表现的是
A. 苦笑面容
B. 吐奶
C. 面色青灰、发绀
D. 拒食、少动
E. 黄疸

正确答案：A。苦笑面容

解析：苦笑面容常见于破伤风感染，新生儿化脓性脑膜炎临床表现不会出现苦笑面容（A错，为本题正确答案）。新生儿化脓性脑膜炎表现多不典型，可表现为吐奶（B对）、面色青灰发绀（C对）、拒食少动（D对）、黄疸（E对）等。